病原体在吸血节肢动物内增殖或完成其生活周期中某阶段后才具有传染性，所需的时间为
A. 潜伏期
B. 外潜伏期
C. 潜隐期
D. 传染期
E. 非传染期

正确答案：B。外潜伏期

解析：本题考查外潜伏期的概念。外潜伏期（B对ACDE错）是指从节肢动物吸入病原体到具有传染性的这段时间。